第二类精神药品的处方应至少保存
A. 1年
B. 2年
C. 3年
D. 4年
E. 5年

正确答案：B。2年

解析：本题考查麻醉药品和精神药品零售规定。第二类精神药品的处方应至少保存2年（B对）。第二类精神药品零售企业应当凭执业医师开具的处方，按规定剂量销售第二类精神药品，并将处方保存2年备查。零售第二类精神药品时，处方应经执业药师或其他依法经过资格认定的药学技术人员复核；第二类精神药品一般每张处方不得超过7日常用量，禁止超剂量或者无处方销售第二类精神药品。